牡丹皮的主要归经是
A. 肺、胃；心
B. 肺、脾、肾
C. 心、脾、肾
D. 心、肝、肾
E. 心、肝、脾

正确答案：D。心、肝、肾

解析：该题考查牡丹皮的性味归经。牡丹皮味苦、辛，性微寒；入心、肝、肾经；具有清热凉血，活血祛瘀的作用”（D对ABCE错） 。